造成牙体缺损，最常见的原因是
A. 楔状缺损
B. 发育畸形
C. 龋病
D. 磨损
E. 外伤

正确答案：C。龋病

解析：本题考查牙体缺损的病因。造成牙体缺损，最常见的原因是龋病（C对）。牙体缺损最常见的原因是龋病，其次是牙外伤（E错）、磨损（D错）、楔状缺损（A错）、酸蚀症和发育畸形（B错）等。